危险度评定的核心内容是
A. 定性评定
B. 剂量反应关系确定
C. 毒性评定
D. 危害性评定

正确答案：B。剂量反应关系确定

解析：本题考查危险度评定的核心内容。危险度评定的核心内容是剂量反应关系确定（B对ACD错）。剂量-反应关系指毒物作用于机体时的剂量与所引起的生物学效应的强度或发生频率之间的关系。它反映毒性效应和接触特征，以及它们之间的关 系，是评价毒物的毒性和确定安全接触水平的基本依据，是毒理学所有分支领域的最基本的研究内容。